女，67岁。因右侧胸腔积液给予规律三联试验性抗结核治疗2个月，近2天出现视力异常。导致上述表现最可能的原因是
A. 类赫氏反应
B. 溶血尿毒综合征
C. 乙胺丁醇不良反应
D. 异烟肼不良反应
E. 利福平不良反应

正确答案：C。乙胺丁醇不良反应

解析：患者为老年女性，有胸腔积液。给予规律三联试验性抗结核治疗2个月，近2天出现视力异常规律，最可能的原因是乙胺丁醇（C对）引起的不良反应（乙胺丁醇的不良反应为视神经炎，应在治疗前测定视力与视野，治疗中密切观察，提醒患者发现视力异常应及时就医）。类赫氏反应（A错）是指传染性肺结核特别是大量排菌的肺结核强化治疗期，由于异烟肼、利福平特别是利福平的强烈杀伤结核菌的作用，造成大量菌体蛋白、磷脂、肽糖及代谢毒素的产生，这些物质作为一种抗原刺激机体产生的一种超敏反应，不会出现视力异常。溶血尿毒综合症（B错）是以溶血性贫血、血小板减少及急性肾功能衰竭为特征的一种综合症，其中由药物导致的继发性溶血尿毒综合症有环孢素、丝裂霉素及避孕药等。异烟肼（D错）常有周围神经炎，偶有肝功能损害等不良反应。利福平（E错）常有肝功能损害和过敏反应等不良反应。